患儿10岁，上前牙牙龈时常流脓1月余。查左上1远中舌面深龋，探无反应，无穿髓孔，牙松动Ⅰ度，叩（+），冷测无反应，唇侧牙龈近根尖处有一窦道。为确定诊断，临床需要作的检查是
A. 电活力测试
B. 穿刺
C. 局部麻醉
D. X线片
E. 涂片

正确答案：D。X线片

解析：根据病例描述，左上1远中舌面深龋，探无反应，无穿髓孔，冷热测无反应，可知患牙牙髓已坏死；上前牙牙龈时常流脓1月余，松I度，叩痛（+），唇侧牙龈近根尖处有一窦道口，可知患牙牙髓炎症已蔓延到根尖周，导致根尖周炎症，综上所述，可初步诊断为慢性根尖周炎。拍摄X线片（D对）可以了解患牙根尖的状况，观察根尖是否有根尖稀疏影或牙根吸收，以进一步确定诊断。电活力测试（A错）主要用于检查牙髓是否有活力，根尖周炎的患牙牙髓可能有活力，也可能没有活力，因此牙髓是否有活力并不能作为确诊根尖周炎的依据。穿刺（B错）是将穿刺针刺入体腔内或肿块内，抽取腔内物质，了解内容物的性质，以协助诊断，本病例中窦道已形成，且牙龈处脓性溢出物明显，故穿刺无意义。局部麻醉（C错）多用来判定引起疼痛的患牙，当其他诊断方法对两颗可疑患牙不能做出最后鉴别，且两颗牙分别位于上、下颌或该两颗牙均在上颌但不相邻时，可采用局部麻醉来确诊患牙，该病例中患牙明确，故局部麻醉对于进一步诊断无意义。涂片（E错）是取脓液或溃疡、创面分泌物进行涂片检查，可观察确定分泌物的性质和感染菌种，此操作不能确定诊断。